足厥阴肝经中穴位定位正确的为
A. 行间在足背第2、3趾间，赤白肉际
B. 太冲在足背侧，第二跖骨间隙的后方凹陷处
C. 章门在侧腹部，第12肋骨的游离端下方
D. 大敦在足二趾末节外侧，距离趾甲角0. 1寸
E. 期门在胸部第六肋间，前正中线旁开4寸

正确答案：E。期门在胸部第六肋间，前正中线旁开4寸

解析：期门定位在胸部第六肋间隙，前正中线旁开4寸（E对）。行间定位在足背，当第1、2趾间的指蹼缘上方纹头处（A错）。太冲定位在足背、第1、2跖骨结合部之前凹陷中（B错）。章门定位在第11肋游离端下际（C错）。大敦定位在足大趾外侧趾甲根角旁约0.1寸（D错）。